嘌呤核苷酸的从头合成，需要下列哪种物质的参与
A. 维生素B
B. 维生素C
C. 维生素K
D. 叶酸
E. 维生素E

正确答案：D。叶酸

解析：叶酸和叶酸制剂进入体内，参与体内多种生化代谢，包括：①嘌呤核苷酸的从头合成；②从尿嘧啶脱氧核苷酸（dUMP）合成胸腺嘧啶脱氧核苷酸（dTMP）；③促进某些氨基酸的互变。掌握“维生素K、抗贫血药和右旋糖酐”知识点。